能抑制胃排空的因素是
A. 壁内神经丛反射
B. 迷走-迷走反射
C. 组胺
D. 进入胃内的食物
E. 肠-胃反射

正确答案：E。肠-胃反射

解析：当食糜进入十二指肠后，通过肠-胃反射（E对）抑制胃的运动，使胃排空减慢，进入胃内的食物（P191）（D错）可通过迷走-迷走反射（B错）和壁内神经丛局部反射（A错）引起胃运动的加强，促进胃排空。组胺（P188）（C错）具有极强的促胃酸分泌作用，对胃排空的影响不大。它由ECL细胞分泌，以旁分泌的方式作用于邻旁壁细胞的H₂型受体，引起壁细胞分泌胃酸，促进胃排空。